人工游泳池应设专人负责池水消毒，卫生清扫，并在每场前测定水中的
A. pH
B. 硫酸铜
C. 总大肠菌群
D. 余氯
E. 尿素

正确答案：D。余氯

解析：本题考查我国《游泳场所卫生标准》。人工游泳池应设专人负责池水消毒，卫生清扫，并在每场前测定水中的余氯（D对ABCE错），以确定再次添加消毒剂的时间。